某患者在医院就诊时，检查结果显示该患者为痰涂片阳性肺结核患者。对与该患者有密切接触的患者家属应采取的措施为
A. 长期服用抗结核药以提高抵抗力
B. 药物预防
C. 接种卡介苗
D. 长期督导化疗
E. 不用采取任何措施

正确答案：B。药物预防